执业药师在合理用药方面应起的作用有
A. 监督药品生产，保证药品质量
B. 向患者宣传相关的用药知识
C. 审查与监督处方中的不合理用药现象
D. 做好药物不良反应的监测
E. 做好药学信息咨询服务

正确答案：B、C、D、E。向患者宣传相关的用药知识；审查与监督处方中的不合理用药现象；做好药物不良反应的监测；做好药学信息咨询服务